化学毒物经下列哪一种生物转化反应后水溶性降低
A. 葡萄糖醛酸结合
B. 羟化作用
C. 硫酸结合
D. 甲基化作用
E. 谷胱甘肽结合

正确答案：D。甲基化作用